男，58岁。反复腹胀、尿少、双下肢水肿2年，加重伴腹痛1周。口服螺内酯及呋塞米后尿量无明显增加。慢性乙型肝炎病史15年。腹腔穿刺抽出淡黄色腹水，腹水白细胞750×10⁶/L，中性粒细胞580×10⁶/L。以下治疗措施中错误的是
A. 腹水浓缩回输
B. 应用广谱抗生素
C. 限制钠盐摄入
D. 补充白蛋白
E. 腹腔穿刺放液

正确答案：A。腹水浓缩回输

解析：中年男性患者，慢性乙型肝炎病史15年（肝硬化的高危因素），尿少、双下肢水肿2年（低白蛋白血症→血浆胶体渗透压下降→毛细血管内液体漏入组织间隙），反复腹胀2年、加重伴腹痛1周、口服螺内酯及呋塞米后尿量无明显增加（顽固性腹水并发感染的常见表现）。腹腔穿刺抽出淡黄色腹水（漏出液为淡黄色，浆液性；渗出液可为血性、脓性、乳糜性等，提示为漏出液），腹水白细胞750×10⁶/L（漏出液常＜100×10⁶/L，渗出液常＞500×10⁶/L，提示为渗出液），判断腹水性质介于渗、漏出性之间（自发性腹膜炎腹水的性质），中性粒细胞580×10⁶/L（约占白细胞总数0.77，正常值0.5～0.75，提示炎症感染）。结合患者病史及腹穿，考虑肝硬化合并自发性腹膜炎。对肝硬化腹水的治疗应在限制水及钠盐摄入（C对）的前提下使用利尿剂治疗，一般联合使用保钾及排钾利尿。在利尿效果不满意时，可酌情补充白蛋白（D对），有利于减轻腹水；亦可直接腹腔穿刺放液（E对）可迅速缓解症状。自发性腹膜炎时选用肝毒性小、主要针对革兰阴性杆菌并兼顾革兰阳性球菌的广谱抗生素（B对）。腹水浓缩回输可增加血容量，抑制抗利尿激素，促进腹水消退，同时避免了外源性蛋白的应用，节省治疗费用，适用于治疗顽固性腹水。患者已出现自发性腹膜炎，腹水中存在病原菌，治疗时不应进行腹水浓缩回输（A错，为本题正确答案）。